需要考虑增加基牙数目的是
A. 基牙为单根牙
B. 基牙轻度倾斜
C. 基牙牙周膜增宽
D. 无对颌功能的基牙
E. 牙槽骨吸收1/3以上

正确答案：E。牙槽骨吸收1/3以上

解析：本题考查需要考虑增加基牙数目的情况。固定桥基牙和桥体所承受的（牙合）力几乎全由基牙来承担，基牙的条件最好是牙根粗长，稳固，多根牙的支持最好，不存在病理性松动，有合适的冠根比。当牙根牙槽骨的吸收超过根长的1/3（E对），必须选用此牙做基牙时，应该增加基牙数目，以分散（牙合）力，增加固位力，保护此基牙。其他条件如基牙为单根牙（A错）、基牙轻度倾斜牙（B错）、基牙牙周膜增宽（C错）、基牙无对颌功能（D错）等对基牙的固位影响不大，不需要考虑增加基牙。